在口腔健康调查中，表示某人群的患病频率的是
A. 龋均
B. 患病率
C. 发病率
D. 菌斑指数
E. 牙龈指数

正确答案：B。患病率

解析：本题考查口腔流行病学常用指数。在口腔健康调查中，表示某人群的患病频率的是患病率（B对）。龋均（A错）反映受检查人群龋病的严重程度。 发病率（C错）指在这个特定时期内，疾病新发生的频率。以下为评价牙周健康的指数：菌斑指数（D错）用于测量口腔中菌斑的情况；牙龈指数（E错）不考虑有无牙周袋及牙周袋深度，只观察牙龈情况，检查牙龈颜色和质的改变以及出血倾向。